下列属于小儿正常指纹的是
A. 指纹沉而不显
B. 指纹细而浅淡
C. 黄红相兼，隐现于风关之内
D. 过风关至气关
E. 过气关达命关

正确答案：C。黄红相兼，隐现于风关之内

解析：指纹沉而不显（A错）提示疾病病位偏里。指纹浅淡，为推之流畅，主虚证，指纹粗细不属于诊法内容（B错）。正常小儿的指纹色泽淡紫，不超过风关，故黄红相兼，隐现于风关之内（C对）。小儿正常指纹不超过风关，故过风关至气关（D错）和过气关达命关（E错）为病理指纹。